应用心理学的方法影响或改变病人的感受、认识、情感和行为，调整个体与环境之间的平衡，称之为
A. 心理诊断
B. 心理治疗
C. 心理卫生
D. 心理咨询
E. 心理适应

正确答案：B。心理治疗